生产性振动按作用人体的部位分为
A. 垂直振动、水平振动
B. 全部振动、部分振动
C. 机械振动、电动振动
D. 全身振动、局部振动
E. 以上全不是

正确答案：D。全身振动、局部振动

解析：本题考查生产性振动对人体的影响。根据振动作用于人体的部位和传导方式，可将生产性振动划分为局部振动和全身振动（D对ABCE错）。手传振动亦称作手臂振动或局部振动。20㎐以下低频率大振幅的全身振动主要影响前庭及内脏器官；40～300㎐高频振动对末梢循环和神经功能的损害较明显。